动机产生的两个条件是
A. 需要和目的
B. 需求和目标
C. 诱因和目的
D. 需要和诱因
E. 意志和目的

正确答案：D。需要和诱因

解析：动机的产生需要具备两个条件：一是内部条件，即需要的存在，动机是在需要的基础上产生的，但需要并不等于动机；另一个是外部的刺激或诱因，它进一步加强这种紧张或焦虑，并使动机的产生和进一步的行动成为可能。掌握“需要与动机”知识点。